男，40岁，慢性肾炎合并胆囊炎宜用
A. 四环素
B. 头孢唑啉
C. 多西环素
D. 庆大霉素
E. 多粘菌素

正确答案：C。多西环素

解析：多西环素属于长效半合成四环素类，是四环素类药物的首选药；口服吸收迅速且完全，大部分药物存在于胆汁，少量药物经肾脏排泄，故对于慢性肾炎合并胆囊炎的患者最好选用多西环素。掌握“四环素、多西环素及米诺环素”知识点。